68岁男性，全口义齿戴用15年，未曾换用新义齿，因进食受限而前来就诊。自述在3月前一次打喷嚏后感觉说话时下颌运动受限。检查：耳屏前方有凹陷，侧面观下颌前伸。X线片：髁突脱位于关节结节前上方。且使用手法复位不成功。则可判断此患者的疾病为
A. 急性前脱位
B. 陈旧性脱位
C. 复发性脱位
D. 翼内肌痉挛
E. 颞下颌关节紊乱综合征

正确答案：B。陈旧性脱位

解析：陈旧性脱位临床表现与急性前脱位相同，患者突然打喷嚏引起急性前脱位，由于长时间未复位，造成陈旧性脱位。根据患者X线片的表现，与手法复位不成功，此患者可以诊断为陈旧性脱位。掌握“颞下颌关节脱位”知识点。